双盲试验的目的在于
A. 保证样本的代表性
B. 保证两组之间的可比性
C. 可避免来自病人和医生两方面的偏倚
D. 消除病人的主观选择研究条件对结果的影响
E. 检验两组的可比性

正确答案：C。可避免来自病人和医生两方面的偏倚

解析：本题考查进行双盲试验的目的。双盲指研究对象和研究实施人员都不了解试验分组情况，而是由研究设计者来安排和控制全部试验。双盲试验的目的是消除研究者和研究对象对结果的主观影响带来的偏倚（C对ABDE错）。